发出纤维形成内侧丘系
A. 薄束核、楔束核
B. 红核
C. 黑质
D. 脑桥核
E. 无

正确答案：A。薄束核、楔束核

解析：薄束核、楔束核（A对）发出的纤维形成内弓状纤维，在中央管腹侧越中线交叉至对侧，形成内侧丘系交叉，交叉后的纤维在中线两侧、锥体束的后方转折上行，形成内侧丘系。